可在水中膨胀，但不溶于水的是
A. 离子交换树脂
B. 三氧化二铝
C. 天然膜
D. 人工合成膜
E. 活性炭

正确答案：A。离子交换树脂

解析：本题考查的是离子交换树脂的结构及性质。可在水中膨胀，但不溶于水的是离子交换树脂（A对）。离子交换树脂的结构及性质：离子交换树脂外观均为球形颗粒，不溶于水，但可在水中膨胀。三氧化二铝（B错）即氧化铝。氧化铝为吸附剂，分离原理都是根据吸附能力大小不同进行分离。另外，氧化铝又分为酸性或碱性氧化铝，如黄酮等酚酸性物质被碱性氧化铝的吸附，或生物碱被酸性氧化铝的吸附等，这又属于化学吸附。天然膜（C错）与人工合成膜（D错）应用于膜分离法中。膜分离法：是一种用天然或人工合成的膜，以外界能量或化学位差为推动力，对双组分或多组分的溶质和溶剂进行分离、分级、提纯或富集的方法。活性炭（E错）是非极性吸附剂，与硅胶、氧化铝相反，对非极性物质具有较强的亲和能力，在水中对溶质表现出强的吸附能力。溶剂极性降低，则活性炭对溶质的吸附能力也随之降低。故从活性炭上洗脱被吸附物质时，洗脱溶剂的洗脱能力将随溶剂极性的降低而增强。